中央性气道阻塞部位在胸膜腔外，呼吸困难主要表现为:
A. 吸气性呼吸困难
B. 呼气性呼吸困难
C. 阵发性呼吸困难
D. 呼吸加深加快
E. 以上都不对

正确答案：A。吸气性呼吸困难

解析：中央性气道阻塞部位在胸膜腔外，呼吸困难主要表现为吸气性呼吸困难（A对）。